48岁，肝硬化病史6年，大量放腹腔积液后出现睡眠障碍，扑翼样震颤，脑电异常最可能的诊断是
A. 肝性脑病1级
B. 肝性脑病2级
C. 肝性脑病3级
D. 肝性脑病4级
E. 亚临床肝性脑病

正确答案：B。肝性脑病2级

解析：中年患者，有肝硬化病史6年（肝性脑病最常见的病因），大量放腹水（肝性脑病的常见诱因）后出现睡眠障碍（肝性脑病1期、2期的表现）、扑翼样震颤（肝性脑病1期、2期、3期的表现）、脑电异常（肝性脑病2期、3期、4期的表现），综合患者的病史、临床表现，根据其临床分期的标准可初步诊断为肝硬化后肝性脑病2期（B对）。肝性脑病1级（A错）脑电图多数正常。肝性脑病3级（C错）一般为可唤醒的昏睡。肝性脑病4级（D错）一般为不能唤醒的昏迷，且没有扑翼样震颤，脑电图明显异常。亚临床肝性脑病（E错）一般不出现肝性脑病的临床表现，仅在定量的神经心理操作测试，或进行视觉诱发电位检查时出现异常，从而提示肝性脑病。